随访特定人群，记录某一人群（事先确定的队列）的死亡经历，由此生成的寿命表称为
A. 寿命表
B. 定群寿命表
C. 现时寿命表
D. 完全寿命表
E. 简略寿命表

正确答案：B。定群寿命表

解析：本题考查定群寿命表的数据来源。定群寿命表（B对ACDE错）的数据由随访观察获得，反映了某一人群（事先确定的队列）的死亡经历。